用标准血清检测血型时，如果受检测者红细胞与A型血清发生凝集，而与B型血清不发生凝集，则受检者的血型是
A. A1型
B. A2型
C. B型
D. AB型
E. O型

正确答案：C。B型